土壤中何种物质的吸附作用最强
A. 土壤中的胶体颗粒
B. 土壤矿物质胶体
C. 土壤中的沙砾
D. 土壤中的有机物残体
E. 土壤中的腐殖质

正确答案：E。土壤中的腐殖质

解析：本题考查土壤中吸附作用最强的物质。土壤中的腐殖质（E对ABCD错）是指有机物经过土壤微生物分解后再合成的一种褐色或暗褐色的大分子胶体物质，它是土壤中最重要的组成部分，具有强大的吸附作用，可以吸附大量的有机物质和无机物质，如氮、磷、钾等，从而改善土壤的肥力，促进植物的生长发育。